按植入体的手术分期设计可将金属种植体分为
A. 根上种植体和根内种植体
B. 一段式种植体和二段式种植体
C. 高熔种植体和低熔种植体
D. 叶状种植体
E. 钉、针型种植体

正确答案：B。一段式种植体和二段式种植体

解析：本题考查种植体的分类。按植入体的手术分期设计可将金属种植体分为一段式种植体和二段式种植体（B对）。按植入体的手术分期设计可将金属种植体分为一段式种植体和二段式种植体，一段式种植体只需一次手术即可将种植体植入，二段式种植体需两次手术完成植入。根上种植体和根内种植体是按照种植部位分类（A错）。高熔种植体和低熔种植体是按照种植体的熔点分类的（C错）。叶状种植体（D错），钉、针型种植体是按照种植体外形分类的（E错）。